男，30岁，餐后突发右上腹及剑突下痛，放射到右肩及后背部，二小时后疼痛剧烈，伴恶心，并吐出所进食物，仍不缓解，急诊就医。数年“胃病”史及胆石症历史，间有胆绞痛发作，查体：痛苦病容，体温37.2℃，呼吸28次/分，浅快，律齐。全腹胀，上腹肌紧张，压痛反跳痛（+）。移动性浊音（±），白细胞12×10⁹/L，血红蛋白125g/L，尿淀粉酶400U（温氏法正常值32μ）。为了确立诊断可选择的检查中，不包括
A. 急诊B超检查
B. 立位腹平片检查
C. 血淀粉酶检查
D. 诊断性腹腔穿刺检查
E. 急诊上消化道钡餐检查

正确答案：E。急诊上消化道钡餐检查

解析：怀疑有胃十二指肠溃疡穿孔的患者应禁忌行上消化道钡餐检查，以免钡剂漏入腹腔，加重病情（E错，为本题正确答案）。B超检查（A对）可用于明确急性胰腺炎和急性胆囊炎的诊断。立位腹部X线平片检查（B对）可用于明确胃十二指肠溃疡穿孔、急性肠梗阻的诊断。血、尿淀粉酶检查（C对）可用于明确急性胰腺炎的诊断。诊断性腹腔穿刺（D对）通过明确腹腔积液的性质，对胃十二指肠溃疡穿孔、急性胰腺炎和急性肠梗阻等具有重要诊断价值。